由螺旋体所致的人畜共患的疾病是
A. 钩端螺旋体病
B. 梅毒
C. 回归热
D. 雅司病
E. 奋森咽喉炎

正确答案：A。钩端螺旋体病

解析：钩体所致的钩体病为人兽共患病。鼠类和猪为主要传染源和储存宿主，其带菌率很高，且排菌期长。掌握“概述及梅毒螺旋体”知识点。